存在于牙周膜的具有多分化潜能的细胞为
A. 成纤维细胞
B. 牙周膜干细胞
C. 成牙骨质细胞
D. Malassez上皮剩余
E. 成骨细胞

正确答案：B。牙周膜干细胞

解析：牙周膜干细胞：是存在于牙周膜中的一种未分化的间充质细胞，具有多向分化潜能及自我更新的能力。掌握“牙周膜”知识点。